去除某因素则疾病频率下降，这是因果关系的
A. 关联的一致性
B. 剂量-反应关系
C. 暴露终止效应
D. 关联的特异性
E. 关联的可重复性

正确答案：C。暴露终止效应